根据《药品经营质量管理规范实施细则》，下列关于药品零售叙述正确的是
A. 药品零售均可采用开架自选的销售方式
B. 顾客反映的药品质量问题，无须记录，直接向药监部门报告
C. 对陈列的药品应按季进行检查，发现质量问题要及时处理
D. 药品销售可以附赠适量药品或礼品
E. 监督电话的号码应与服务公约同时悬挂在店堂内醒目处

正确答案：D。药品销售可以附赠适量药品或礼品